患者，男，大一学生，周围环境不适应。治疗方法为
A. 心理咨询
B. 住院观察
C. 特别照顾
D. 任其自己调整
E. 人本主义

正确答案：E。人本主义

解析：文中的患者有社会适应不良的问题，可以通过人本主义疗法（E对）得到治疗，通过适当的引导使其接纳自己的情绪感受，该疗法的目的在于帮助患者在治疗中成为自己，从而让个体变得更相信自己，变成一个较少防御性和更多对经验抱着开放态度、协调一致的人，从而更好地适应社会环境，符合文中患者的情况。心理咨询（P196）（A错）的对象一般是有现实问题或心理干扰的正常人，但文中的对象是有心理障碍的患者，所以既不能任其自己调整（D错），也不能只靠心理咨询。住院观察（B错）和特别照顾（C错）一般用于患较严重的心理疾病乃至威胁到自身及周围的身体安全的患者，比如精神分裂症等。